薄层色谱法常用的吸附剂有
A. 硅胶
B. 聚乙二醇
C. 氧化铝
D. 硅氧烷
E. 鲨鱼烷

正确答案：A、C。硅胶；氧化铝